既往体健，突然恶心、呕吐，甲丙肝阴性，可能的诊断是
A. 急性乙肝
B. 慢性乙肝
C. 肝硬化
D. 肝癌
E. 自身免疫性肝炎

正确答案：A。急性乙肝

解析：患者既往体健，突然恶心、呕吐，甲丙肝阴性，结合患者的表现，可能的诊断是急性乙肝（A对BC错）。